片剂需用稀释剂或吸收剂者，正确的为
A. 主药剂量小于0.1g者
B. 中药片浸膏含量少者
C. 浸膏粘性太大时
D. 含有较多挥发油者
E. 含有其他液体药物者

正确答案：A、C、D、E。主药剂量小于0.1g者；浸膏粘性太大时；含有较多挥发油者；含有其他液体药物者

解析：本题考查的是片剂的稀释剂与吸收剂。片剂需用稀释剂或吸收剂者，正确的为主药剂量小于0.1g者（A对）、浸膏粘性太大时（C对）、含有较多挥发油者（D对）与含有其他液体药物者（E对）。稀释剂与吸收剂：统称为填充剂。前者适用于主药剂量小于0.1g，或浸膏黏性太大，或含浸膏量多（B错）而制片困难者；后者适用于原料药（含中间体）中含有较多挥发油、脂肪油或其他液体，而需制片者。